女，3个半月。混合喂养，腹泻2个月，大便5～6次/天，稀或糊便，无脓血，食欲好。面部湿疹，体重5.8kg。最可能的诊断是
A. 迁延性腹泻
B. 慢性腹泻
C. 感染性腹泻
D. 饮食性腹泻
E. 生理性腹泻

正确答案：E。生理性腹泻

解析：该患儿虽有腹泻，但便无脓血，食欲好，面部有湿疹，体重正常，不影响生长发育，也无脱水或全身中毒症状，可诊断为生理性腹泻（E对）。患儿腹泻时间虽长，但无急性腹泻病史，所以不能判定为迁延性（A错）和慢性腹泻（B错）。感染性腹泻由进入体内的病原菌引起，根据毒力大小不同会有不同的中毒表现，排出的大便形态也会不同，有的会有脓血便，实验室检查也会有白细胞升高（C错）。饮食性腹泻会发生脱水和电解质紊乱，而此患儿食欲好，体重正常，未有其他症状出现（D错）。